女，53岁。外阴瘙痒数年，外阴皮肤黏膜萎缩变薄，色白，发亮，阴蒂萎缩且与包皮粘连。该患者最可能的诊断是
A. 外阴硬化性苔癣
B. 外阴上皮增生
C. 外阴上皮内瘤样病变
D. 外阴硬化性苔藓合并鳞状上皮增生
E. 皮肤病

正确答案：A。外阴硬化性苔癣

解析：该患者为老年女性（外阴硬化性苔癣可发生于任何年龄，但以绝经后妇女多见），外阴瘙痒数年（主要表现为外阴病损区瘙痒及外阴烧灼感），外阴皮肤黏膜萎缩变薄，色白，发亮，阴蒂萎缩且与包皮粘连（可出现外阴萎缩，皮肤颜色变白、发亮、晚期病变则出现皮肤进一步萎缩菲薄呈“雪茄纸”或羊皮样改变，阴道口挛缩狭窄），故该患者最可能的诊断外阴硬化性苔癣（A对）。外阴上皮增生（P241）（B错）表现为外阴瘙痒、晚期皮肤增厚、色素加深、皮肤纹理明显，出现苔藓样变。外阴硬化性苔藓合并鳞状上皮增生（P243）（D错）指两种病变同时存在，主要症状为外阴瘙痒、皮肤萎缩，变薄伴有局部隆起等。外阴上皮内瘤样病变（P297）（C错）主要症状为外阴瘙痒、皮肤破损、烧灼感及溃疡等，确诊需要依据活体组织病理检查。